黏膜免疫的免疫球蛋白为
A. IgA
B. IgE
C. IgD
D. IgG
E. IgM

正确答案：A。IgA